某女，38岁。大便秘结，腹胀，腹痛，胸胁痞满。证属气秘，宜选用的中成药是
A. 枳实导泄丸
B. 四磨汤囗服液
C. 复方芦荟胶囊
D. 苁蓉通便囗服液
E. 小建中合剂

正确答案：B。四磨汤囗服液

解析：本题考查便秘之气秘的中成药应用。证属气秘，宜选用的中成药是四磨汤口服液（B对）。便秘之气秘【症状】大便干结，或不甚干结，欲便不得出，或便出不爽，胸胁痞满，肠鸣矢气，腹中胀痛，嗳气频作，纳食减少。舌苔薄腻，脉弦。【中成药应用】四磨汤口服液、厚朴排气合剂。泄泻之食滞肠胃证【症状】腹痛肠鸣，泻下粪便臭如败卵，泻后痛减，泻下伴有不消化食物，脘腹胀满，嗳腐吞酸，不思饮食。舌淡红，苔垢浊或厚腻，脉滑实。【中成药应用】加味保和丸、枳实导滞丸（A错）、和中理脾丸。便秘之热秘【症状】大便干结，腹胀腹痛，口干口臭，面红心烦，或有身热，小便短赤。舌红，苔黄燥，脉滑数。【中成药应用】麻仁胶囊、麻仁润肠丸、麻仁滋脾丸、通幽润燥丸、清泻丸、复方芦荟胶囊（C错）。便秘之虚秘【症状】大便并不干硬，虽有便意，但排便困难，用力努挣则汗出短气，便后乏力，面白神疲，肢倦懒言。舌淡苔白，脉弱。【中成药应用】便秘通、便通胶囊、芪蓉润肠口服液、苁蓉通便口服液（D错）。便秘之冷秘【症状】大便艰涩，腹痛拘急，胀满拒按，胁下偏痛，手足不温，呃逆呕吐。舌苔白腻，脉弦紧。【中成药应用】此类便秘为气血不足，寒邪与胃肠积滞互结，阻滞气机，气机逆乱所致，病情较急，应以温散通下之汤剂，荡涤寒积为主，可联用部分中成药辅助治疗，如选用小建中合剂（E错）与四磨汤口服液联合使用等。